药物经济学研究中应注意的问题有
A. 成本测算
B. 样本数
C. 股市行情
D. 汇率比
E. 依从性

正确答案：A、B、D。成本测算；样本数；汇率比